患者一氧化碳中毒，被人发现时处于昏迷状态，主要损伤的脏器为
A. 胃肠
B. 肝
C. 肺
D. 肾
E. 脑

正确答案：E。脑

解析：当患者一氧化碳中毒，被人发现时处于昏迷状态，脑是主要损伤的脏器（E对ABCD错）。